患者，女，35岁。黄疸贫血伴关节酸痛3个月，体检检査巩膜黄染，脾肋下2cm，血红蛋白58g/L，白细胞5×10⁹/L，网织红细胞计数25%，外周血涂片成熟红细胞形态正常，尿隐血试验阴性。首选哪项治疗
A. 脾切除
B. 长春新碱
C. 糖皮质激素
D. 环磷酰胺
E. 大剂量丙种球蛋白

正确答案：C。糖皮质激素

解析：考虑患者为温抗体型自身免疫性溶血性贫血（AIHA），其治疗首选糖皮质激素（C对），有效率80%以上。脾切除（A错）为二线治疗，适用于糖皮质激素无效或维持量较大者及激素应用禁忌证或不能耐受者；长春新碱（B错）、环磷酰胺（D错）属于免疫抑制剂，只有在皮质激素和脾切除都不缓解、有脾切除禁忌症、泼尼松维持量大于10mg/d时才可使用；大剂量免疫球蛋白（E错）静脉注射或血浆置换术可有一定疗效，但作用不持久，一般不作为首选。